性早熟治疗原则
A. 女童在8岁以前出现乳房增大，阴毛、腋毛生长等第二性征的一种或一种以上者，均属性早熟
B. 包括真性性早熟和假性性早熟
C. 原则上是针对病因进行治疗。治疗目的在于抑制排卵、抑制月经、减慢第二性征的发育，预防身材过矮，促进身心的协调发展和心理健康
D. 女童在14岁以前出现第二性征发育，属性早熟
E. 由肿瘤引起的假性性早熟，尚无特殊疗法，可用大剂量孕激素抑制促性激素的分泌，其效果观察6～12个月

正确答案：C。原则上是针对病因进行治疗。治疗目的在于抑制排卵、抑制月经、减慢第二性征的发育，预防身材过矮，促进身心的协调发展和心理健康

解析：本题考查性早熟的治疗原则。性早熟的治疗原则主要包括：针对病因进行治疗，去除病因。治疗目的在于抑制排卵、抑制月经、抑制第二性征的发育；延缓骨成熟的时间，防止骨骺线早期闭合所导致身材矮小；防止患儿和家长出现心理和社会适应障碍，促进身心的协调发展和心理健康（C对ABDE错）。